某男，18岁，夏季贪凉饮冷，遂致外感于寒，内伤于湿，症见恶寒发热，无汗头痛，头重身倦，胸闷泛恶，舌苔薄白而腻。医师诊为阴暑，处方为香薷、厚朴、白扁豆，水煎服。医师在方中选用香薷，是因其能
A. 发汗解表，行气调中
B. 发汗解表，温中止呕
C. 发汗解表，化湿和中
D. 发汗解表，渗湿止痛
E. 发汗解表，温通经脉

正确答案：C。发汗解表，化湿和中

解析：本题考查的是香薷的功效。医师在方中选用香薷，是因其能发汗解表，化湿和中（C对）。香薷：【功效】发汗解表，和中化湿，利水消肿。生姜：【功效】发汗解表，温中止呕（B错），温肺止咳。功效为发汗解表，行气调中（A错）、发汗解表，渗湿止痛（D错）与发汗解表或温通经脉（E错）的中药，2022年考试指南未明确说明。